阿托品的结构类型是
A. 喹啉类
B. 异喹啉类
C. 莨菪烷类
D. 苄基异喹啉类
E. 双苄基异喹啉类

正确答案：C。莨菪烷类

解析：本题考查的是阿托品的结构类型。阿托品的结构类型是莨菪烷类（C对）。莨菪烷类生物碱：多来源于鸟氨酸，由莨菪烷环系的C₃-醇羟基与有机酸缩合成酯。主要存在于茄科的颠茄属、曼陀罗属、莨菪属和天仙子属。重要化合物有莨菪碱、古柯碱等。洋金花主要化学成分为莨菪烷类生物碱，由莨菪醇类和芳香族有机酸结合生成的一元酯类化合物。主要有莨菪碱（阿托品）、山莨菪碱、东莨菪碱、樟柳碱和N-去甲莨菪碱。《中国药典》以东莨菪碱为指标成分进行含量测定，要求东莨菪碱不得少于0.15%。异喹啉类（B错）生物碱：来源于苯丙氨酸和酪氨酸系，具有异喹啉或四氢异喹啉的基本母核，在植物中分布广泛，数目较多，具有多方面的生物活性。根据其基本结构又分为多种类型，主要类型如下。（1）简单异喹啉类：如鹿尾草中的降血压成分萨苏林，是四氢异喹啉的衍生物。（2）苄基异喹啉类（D错）：又分为1-苄基异喹啉类和双苄基异喹啉类。①1-苄基异喹啉类：为异喹啉母核1位连有苄基的一类生物碱。如罂粟中具解痉作用的罂粟碱，乌头中的强心成分去甲乌药碱，厚朴中的厚朴碱等。②双苄基异喹啉类（E错）：为两个苄基异喹啉通过1～3个醚键相连接的一类生物碱。如存在于防己科北豆根中的主要酚性生物碱蝙蝠葛碱，汉防己中的汉防己甲素和汉防己乙素，十大功劳中的异汉防己甲素。